分析空气中一氧化碳宜采用的样品采集方法是
A. 塑料袋采样法
B. 注射器采样法
C. 溶液吸收法
D. 滤膜阻留法
E. 固体吸附剂阻留法

正确答案：A。塑料袋采样法

解析：本题考查样品采集方法。分析空气中一氧化碳宜采用塑料袋采样法（A对BCDE错）。塑料袋采样法是一种简单、快速、经济的采样方法，它可以有效地收集空气中的一氧化碳，并且可以在实验室中进行分析。其原理是将一个塑料袋放置在空气中，然后用一个泵将空气吸入塑料袋中，这样就可以收集到空气中的一氧化碳。